属于地区分布的是
A. 石棉工人中间皮瘤、肺癌及胃肠癌的发生率高于其他职业人群
B. 水痘、流行性脑脊髓膜炎和流行性感冒等常在大城市发生流行
C. 因诊断水平的提高使患病率升高
D. 流行性乙型脑炎和脊髓灰质炎多为隐性感染
E. 2015年上海市甲型H1N1流感流行在冬春季节

正确答案：B。水痘、流行性脑脊髓膜炎和流行性感冒等常在大城市发生流行

解析：本题考查疾病的地区分布。疾病频率在国家间及国家内不同地区间和城乡之间的分布存在差别，某些疾病存在地区聚集性。城市人口的密度大、居住面积狭窄、人口流动性大和交通拥挤等，呼吸道传染病容易传播，如水痘、流行性脑脊髓膜炎和流行性感冒等常在大城市发生流行（B对ACDE错）。